患者腹痛拘急，痢下赤白黏冻，白多赤少，里急后重，脘腹胀满，舌苔白腻，脉濡缓。治疗应首选
A. 藿香正气散
B. 不换金正气散
C. 葛根芩连汤
D. 白头翁汤
E. 芍药汤

正确答案：B。不换金正气散

解析：藿香正气散为泄泻寒湿内盛证的选方，亦可用于暑天感寒湿而痢者，功能解表散寒化湿，理气和中（A错）。题中患者以腹痛拘急，痢下赤白黏冻，白多赤少，里急后重为主症，故诊断为痢疾。腹痛拘急，里急后重为寒湿之邪滞留肠胃，寒主收引，湿邪凝滞，气机阻滞证所致，寒湿之邪伤于气分，故痢下赤白黏冻，白多赤少，寒湿困脾，脾失健运，故脘腹胀满。舌苔白腻，脉濡缓为寒湿内盛之象，故辨为寒湿痢，治宜温中燥湿，调气和血，方选不换金正气散（B对）。葛根芩连汤为泄泻湿热伤中证的选方，功能解表清里，升清止泻（C错）。白头翁汤常合芍药汤治疗痢疾疫毒痢，功能清热凉血解毒（D错）。芍药汤为痢疾湿热痢的选方，功能调气行血，清热解毒（E错）。